慢性骨髓炎最有意义的诊断依据是
A. 皮肤有窦道并见死骨排出
B. 局部肿痛及患肢功能障碍
C. 寒战、高热等感染中毒症状
D. 白细胞总数及中性粒细胞增高
E. X线未见骨质破坏和骨膜反应

正确答案：A。皮肤有窦道并见死骨排出

解析：慢性骨髓炎是由急性化脓性骨髓炎迁延不愈所致，其特点为死骨形成、骨性包壳及皮肤窦道形成。皮肤有窦道并见死骨排出（A对）为慢性骨髓炎的特征性临床表现，对诊断慢性骨髓炎最有意义。局部肿痛及患肢功能障碍（B错）、寒战高热等全身中毒症状（C错）、白细胞总数及中性粒细胞增高（D错）等为慢性骨髓炎急性发作时的一般表现，不是最有意义的诊断依据。慢性骨髓炎早期X线可出现虫蚀样的骨质破坏与骨质稀疏（E错）。